女性，25岁。午后发热3周，咳嗽，咳少量白色黏痰。体检：左肩胛区闻及少量湿罗音，血沉40mm/h，白细胞10x10⁹/L，中性粒细胞0.75，胸片示左第二前肋斑片状浸润阴影。如不及时治疗，最易出现
A. 亚急性血行播散
B. 空洞形成
C. 结核性胸膜炎
D. 慢性纤维空洞
E. 病变硬结钙化

正确答案：B。空洞形成